既有黏痰溶解作用，还有解救对乙酰氨基酚中毒作用的药物
A. 乙酰半胱氨酸
B. 氯化铵
C. 氨溴索
D. 右美沙芬
E. 可待因

正确答案：A。乙酰半胱氨酸

解析：本题考查乙酰半胱氨酸药理作用。乙酰半胱氨酸（A对）具有较强的黏痰溶解作用，还可用于对乙酰氨基酚中毒的解救，治疗环磷酰胺引起的出血性膀胱炎。